患儿，男，12岁。2年前诊断为1型糖尿病。今日在家中用胰岛素治疗后，突然发生昏迷。应首选的抢救措施是：
A. 小剂量胰岛素静滴
B. 静脉补充氯化钾
C. 快速补充生理盐水
D. 静脉补充高渗葡萄糖
E. 静脉补充碳酸氢钠

正确答案：D。静脉补充高渗葡萄糖

解析：本例患者为青少年男性，属于1型糖尿病患者，此次胰岛素治疗后突发昏迷，可能是胰岛素注射过量导致的低血糖性昏迷，故首选的抢救措施是静脉补充高渗葡萄糖（D对）。小剂量胰岛素静滴（A错）会进一步加重低血糖，使病情恶化。静脉补充氯化钾（B错）主要用于治疗低钾血症。快速补充生理盐水（P754）（C对）常用于治疗糖尿病并发症如糖尿病酮症酸中毒、高渗高血糖综合征。静脉补充碳酸氢钠（P754）（E错）常用于严重酸中毒，使用指征为血pH＜7.1，HCO3-＜5mmmol/L。